材料三：相关药品生产、经营企业信息：（1）甲是A市的药品批发企业，质量管理部门负责人李某为注册在该企业的执业药师；（2）乙是A市的一家药品零售连锁企业总部，具备处方药、非处方药经营资格，执业药师林某是该企业的质量负责人；（3）丙是乙所辖直营门店，位于B市，具备处方药、非处方药经营资格，执业药师王某是注册在该门店的唯一执业药师；（4）丁是A市的非连锁药品零售企业，只具备非处方药经营资格；（5）戊是药品生产企业。二、相关背景：执业药师“挂证”是一种严重违反执业药师职业道德操守的行为，给执业药师形象造成了恶劣的负面影响，必须予以坚决的打击和有效的遏制。国家药品监督管理局印发通知，2019年4月起，在全国范围内开展为期6个月的执业药师挂证”专项整治行动，5月1日前全国药品零售企业必须完成自查自纠，限期整改，清退“挂证”执业药师，并做到执业药师在岗真实执业，逾期未整改不到位的，不得开展药品经营活动，否则将予以严肃查处。国家整治执业药师“挂证”行动自查自纠期结束后，负责药品监督管理的部门对丙零售企业突击检查，查实注册执业药师王某系“挂证”，药品监督管理部门对其作出的相关处置。其中，不符合药品监管法律法规规定的是
A. 认定执业药师王某的“挂证”行为是严重违反药品经营质量管理规范的情形，撤销丙零售企业的《药品经营质量管理规范认证证书》
B. 撤销执业药师王某的《执业药师注册证》
C. 吊销执业药师王某的《执业药师职业资格证书》
D. 在全国执业药师注册管理信息系统对王某的“挂证”行为进行记录，并予以公示

正确答案：C。吊销执业药师王某的《执业药师职业资格证书》

解析：本题考查的是执业药师执业活动的监督。国家整治执业药师“挂证”行动自查自纠期结束后，负责药品监督管理的部门对丙零售企业突击检查，查实注册执业药师王某系“挂证”，药品监督管理部门对其作出的相关处置。其中，不符合药品监管法律法规规定的是吊销执业药师王某的《执业药师职业资格证书》（C错，为本题正确答案）。国家药品监督管理局与人力资源社会保障部按照职责分工对执业药师职业资格制度实施和执业药师执业行为进行监督和检查。负责药品监督管理的部门按照有关规定对执业药师配备情况及其执业活动实施监督检查，包括监督检查以不正当手段取得《执业药师职业资格证书》，以欺骗、贿赂等不正当手段取得《执业药师注册证》，未按规定配备执业药师，挂靠《执业药师注册证》（执业药师“挂证”）单位买卖、租借《执业药师注册证》等违法违规行为。同时将建立执业药师个人诚信记录，对其执业活动实行信用管理。执业药师的违法违规行为、接受表彰奖励及处分等，作为个人诚信信息由负责药品监督管理的部门及时记入全国执业药师注册管理信息系统；执业单位和执业药师应当对负责药品监督管理的部门的监督检查予以协助、配合，不得拒绝、阻挠。按照12号文及药品经营质量管理相关规定，对以不正当手段取得《执业药师职业资格证书》的，按照《专业技术人员资格考试违纪违规行为处理规定》（人力资源社会保障部令第31号）相关规定处理。以欺骗、贿赂等不正当手段取得《执业药师注册证》的，由发证部门撤销《执业药师注册证》，三年内不予执业药师注册，构成犯罪的，依法追究刑事责任。对存在“挂证”行为的执业药师，撤销其《执业药师注册证》（B对），在全国执业药师注册管理信息系统进行记录，并予以公示（D对），在不良信息记录撤销前，不能再次注册执业。药品零售企业存在“挂证”执业药师的，按严重违反《药品经营质量管理规范》情形进行处罚。